由抗内因子（胃壁细胞蛋白，协助维生素B12在小肠吸收）自身抗体引起
A. 自身免疫性血小板减少性紫癜
B. 自身免疫性中性粒细胞减少症
C. 重症肌无力
D. 肺出血肾炎综合征
E. 恶性贫血

正确答案：E。恶性贫血

解析：恶性贫血是由抗内因子（胃壁细胞蛋白，协助维生素B12在小肠吸收）自身抗体引起。内因子被自身抗体结合后，不能协助B12在小肠吸收，造成维生素B12缺乏，使个体的红细胞生成障碍。掌握“常见口腔自身免疫性疾病及自身免疫性疾病的治疗”知识点。